治疗太阳头痛的引经药是
A. 柴胡、黄芩、川芎
B. 杜仲、桑寄生、续断
C. 羌活、蔓荆子、川芎
D. 葛根、白芷、知母
E. 吴茱萸、藁本

正确答案：C。羌活、蔓荆子、川芎

解析：太阳头痛多在头后部，下连于项，常选用羌活，蔓荆子，川芎作为引经药（C对）。少阳头痛多在两侧，并连及耳部，多选用柴胡，黄芩，川芎作为引经药（A错）。杜仲、桑寄生、续断为干扰选项（B错）。阳明经头痛多在前额及眉棱骨处，多选葛根，白芷，知母作为引经药（D错）。厥阴头痛多在巅顶部，或连于目系，常选用吴茱萸，藁本等（E错）。